肥达反应的原理是
A. 间接凝集反应
B. 协同凝集反应
C. 沉淀反应
D. 直接凝集试验，用已知抗体测未知抗原
E. 直接凝集试验，用已知抗原测未知抗体

正确答案：E。直接凝集试验，用已知抗原测未知抗体

解析：肥达氏试验的原理是直接凝集试验。用伤寒菌体（O）抗原、鞭毛（H）抗原和甲、乙副伤寒H抗原，与患者系列稀释血清进行凝集试验。掌握“志贺氏及沙门氏菌属”知识点。